呈宽卵形或长椭圆形，表面乳白色，光滑，偶有残存的黄褐色种皮，一端钝圆，另一端较宽而微凹；背面圆凸，腹面有1条较宽而深的纵沟；气微，味微甜的片是
A. 决明子
B. 燀桃仁
C. 葶苈子
D. 牛蒡子
E. 薏苡仁

正确答案：E。薏苡仁

解析：本题考查的是薏苡仁的性状鉴别。呈宽卵形或长椭圆形，表面乳白色，光滑，偶有残存的黄褐色种皮，一端钝圆，另一端较宽而微凹；背面圆凸，腹面有1条较宽而深的纵沟；气微，味微甜的片是薏苡仁（E对）。薏苡仁：【性状鉴别】药材呈宽卵形或长椭圆形。表面乳白色，光滑，偶有残存的黄褐色种皮。一端钝圆，另端较宽而微凹，有一淡棕色点状种脐；背面圆凸，腹面有1条较宽而深的纵沟。质坚实，断面白色，粉性。气微，味微甜。决明子（A错）：【性状鉴别】药材决明略呈菱状方形或短圆柱形，两端平行倾斜。表面绿棕色或暗棕色，平滑有光泽。一端较平坦、另端斜尖，背腹面各有1条突起的棱线，棱线两侧各有1条斜向对称而色较浅的线形凹纹。质坚硬，不易破碎。种皮薄，子叶2，黄色，呈“S”形折曲并重叠。气微，味微苦。桃仁（B错）：【性状鉴别】饮片燀桃仁：呈扁长卵形。表面浅黄白色，一端尖，中部膨大，另端钝圆稍偏斜，边缘较薄。子叶2，富油性。气微香，味微苦。葶苈子（C错）：【性状鉴别】药材南葶苈子：呈长圆形略扁。表面棕色或红棕色，微有光泽，具纵沟2条，其中1条较明显。一端钝圆，另端微凹或较平截，种脐类白色，位于凹入端或平截处。气微，味微辛、苦，略带黏性。牛蒡子（D错）：【性状鉴别】药材呈长倒卵形，略扁，微弯曲。表面灰褐色，带紫黑色斑点，有数条纵棱，通常中间1～2条较明显。顶端钝圆，稍宽，顶面有圆环，中间具点状花柱残迹；基部略窄，着生面色较淡。果皮较硬，子叶2，淡黄白色，富油性。气微，味苦后微辛而稍麻舌。